食用克伦特罗喂养的瘦肉型猪的肝脏后，可以造成
A. 发热、出汗、虚脱
B. 呕吐、肌肉震颤
C. 皮肤色素沉着
D. 疲倦、乏力、嗜睡
E. 面色潮红或苍白

正确答案：B。呕吐、肌肉震颤

解析：本题考查瘦肉精中毒的表现。食用克伦特罗喂养的瘦肉型猪的肝脏后，可以造成呕吐、肌肉震颤（B对）。盐酸克仑特罗是选择性β₂受体激动剂，该药有松弛支气管平滑肌的作用，临床上主要用于支气管哮喘。同时，克仑特罗还可以起消除脂肪、增加体重的作用。克仑特罗在动物肝脏中容易引起蓄积，食用者极易发生中毒，其症状有心悸、心动过速、紧张、震颤、胃肠道反应、眩晕、肌痛、关节痛、头痛、昏迷、发热和寒颤等。